小建中汤配伍芍药的意义是
A. 益阴养血，柔肝缓急
B. 养阴复脉，柔肝缓急
C. 益气养阴，缓急止痛
D. 益气养血，复脉定悸
E. 养阴补血，活血通脉

正确答案：C。益气养阴，缓急止痛

解析：小建中汤主治中焦虚寒，肝脾失调，阴阳不和证，功以温中补虚，和里缓急。方中酸苦之芍药，其用有三：一者滋养营阴，以补营血之亏虚；二者柔缓肝急止腹痛（C对），与饴糖相伍，酸甘化阴，养阴缓急而止腹痛拘急；三者与桂枝相配，调和营卫、夑理阴阳，与桂枝共为臣药。